属于牙膏中洁净剂的是
A. 薄荷
B. 丙三醇
C. 苯甲酸盐
D. 二氧化硅
E. 月桂醇硫酸钠

正确答案：E。月桂醇硫酸钠

解析：清净剂：又称发泡剂或表面活化剂，约占1%～2%。它可以降低表面张力，穿通与松解表面沉积物与色素，乳化软垢，刷牙时容易被清除。如月桂醇硫酸钠、n-十二烷基氨酸钠、椰子单酸甘油酯磺酸钠。掌握“自我口腔保健方法”知识点。